氯丙嗪的临床应用包括
A. 惊厥
B. 精神分裂症
C. 抑郁症
D. 低温麻醉
E. 顽固性呃逆

正确答案：B、D、E。精神分裂症；低温麻醉；顽固性呃逆

解析：本题考查氯丙嗪的临床应用。氯丙嗪的临床应用：①治疗精神分裂症（B对）；②治疗顽固性呃逆（E对）；③低温麻醉（D对），合用某些中枢抑制药如异丙嗪和哌替啶等组成冬眠合剂。